不得添加抑菌剂的注射剂有
A. 中药肌内注射液
B. 静脉输液
C. 硬膜外注射液
D. 脑内注射液
E. 椎管内注射液

正确答案：B、C、D、E。静脉输液；硬膜外注射液；脑内注射液；椎管内注射液

解析：本题考查注射剂的附加剂。不得添加抑菌剂的注射剂有静脉输液（B对）、硬膜外注射液（C对）、脑内注射液（D对）、椎管内注射液（E对）。抑制微生物增殖的附加剂：多剂量包装的注射液可加适宜的抑菌剂。抑菌剂的用量应能抑制注射液中微生物的生长，在制剂确定处方时，该处方的抑菌效力应符合《中国药典》抑菌效率检查法的规定。加有抑菌剂的注射液，仍应采用适宜的方法灭菌。静脉给药与脑池内、硬膜外、椎管内用的注射液均不得加抑菌剂。